促进Hb转变为HbO₂的因素是
A. CO₂分压增高
B. 氧分压增高
C. 血液[H⁺]增高
D. 温度增加
E. 血液pH下降

正确答案：B。氧分压增高